关于“防病治病，救死扶伤”的说法错误的是
A. 继承了历史上最优良的医德传统
B. 总结了革命根据地医疗卫生实践的经验
C. 反映了医疗卫生事业的基本特点
D. 对患者的权利给以尊重和保护
E. 更好地为无产阶级革命事业服务

正确答案：D。对患者的权利给以尊重和保护

解析：D选项是实行社会主义人道主义的特点，所以选D。“防病治病，救死扶伤”继承了、历史上最优良的医德传统，总结了革命根据地医疗卫生实践的经验，反映了医疗卫生事业的基本特点。掌握“医学伦理的指导原则”知识点。